处方中的并开药“金银花藤”，执业药师在调配时应付
A. 金银花、首乌藤
B. 金银花、金银藤
C. 金银花、海风藤
D. 款冬花、金银藤
E. 款冬花、首乌藤

正确答案：B。金银花、金银藤

解析：本题考查的是饮片的处方应付。处方中的并开药“金银花藤”，执业药师在调配时应付金银花、金银藤（B对）。处方药名为忍冬花藤或金银花藤时，调配应付金银花、金银藤。